MNL是下列哪个概念的英文缩写
A. 确定动物最大无作用剂量
B. 人体每日容许摄入量
C. 水分活性
D. 蛋白质功效比值
E. 挥发性盐基总氮

正确答案：A。确定动物最大无作用剂量